下列药物中，宜包煎的是
A. 石膏
B. 麻黄
C. 阿胶
D. 车前子
E. 人参

正确答案：D。车前子

解析：包煎主要用于黏性强、粉末状及药材表面带有绒毛的药物，宜先用纱布袋装好，再与其他药物同煎；车前子煎煮后药液黏稠不便于滤取药汁，所以入药宜包煎（D对）。石膏（A错）有效成分难溶于水，所以入药宜先煎。麻黄（B错）煎煮时与其他药物同煎即可。阿胶（C错）一般烊化后服用。人参（E错）是贵重药材，为了更好煎出有效成分应单独另煎。